在双变量（X，Y）的相关与回归分析中有
A. r值与b值的符号相同
B. r值与b值毫无关系
C. r=b
D. r值越大，b值越小
E. r值与b值的单位相同

正确答案：A。r值与b值的符号相同